不符合腺病毒肺炎胸部X线特点的是
A. X线改变比肺部啰音出现早
B. 大片状阴影
C. 肺气肿多见
D. 肺脓肿多见
E. 病灶吸收缓慢

正确答案：D。肺脓肿多见